注射青霉素引起过敏性休克，血压下降，是由血管活性物质引起的生物学效应，这种休克的发生是由哪种效应所致
A. 支气管平滑肌收缩
B. 腺体分泌增加
C. 毛细血管扩张
D. 血管通透性增加
E. 以上全部是

正确答案：E。以上全部是